眩晕头痛，胸脑痞闷，恶心呕吐，舌苔白腻，脉弦滑者，治宜选用
A. 温胆汤
B. 镇肝熄风汤
C. 羚角钩藤汤
D. 天麻钩藤饮
E. 半夏白术天麻汤

正确答案：E。半夏白术天麻汤

解析：患者苔白腻，脉弦滑提示体内痰湿内盛；胸脘痞闷，恶心呕吐，提示脾虚痰湿停聚脾胃；眩晕头痛，是风痰上扰清窍的表现，故用半夏白术天麻汤化痰息风，健脾祛湿（E对）。温胆汤（A错）的功用为理气化痰，清胆和胃。主治：胆胃不和，痰热内扰证。镇肝熄风汤（B错）的功用为镇肝息风，滋阴潜阳。主治：类中风。羚角钩藤汤（C错）的功用为凉肝息风，增液舒筋。主治：肝热生风证。天麻钩藤饮（D错）主治肝阳偏亢，肝风上扰证。